已知某省山区、丘陵、湖区婴幼儿体格发育有较大的差异，现需制定该省婴幼儿体格发育有关指标的参考值范围，抽样方法最好采取
A. 分层抽样
B. 整群抽样
C. 系统抽样
D. 机械抽样
E. 单纯随机抽样

正确答案：A。分层抽样

解析：已知某省山区、丘陵、湖区婴幼儿体格发育有较大的差异（将总体全部个体按某种特征分成若干层），现需制定该省婴幼儿体格发育有关指标的参考值范围（再从某一层内随机抽取一定数量的个体合起来组成样本），抽样方法最好采取分层抽样（A对）。整群抽样（P18）（B错）先将总体分成若干群体，形成一个抽样框；从中随机抽取几个群体组成样本；对抽中群体的全部个体进行调查。系统抽样（P18）（C错）又称机械抽样（D错），是按照某种顺序给总体中的各个体编号，然后随机的抽取一个编号作为第一调查个体，其他的调查个体则按照某种确定的规则抽取。单纯随机抽样（P17）（E错）是指所有抽样的基本单位有同等的概率被抽取的抽样方法。